患者，男，30岁。两天前因食不洁水果，出现腹痛腹泻，下痢赤白，里急后重，肛门灼热，心烦口渴，小便短赤，舌苔黄腻，脉滑数。治疗除取主穴外，还应加
A. 中脘、气海
B. 中脘、内关
C. 行间、足三里
D. 曲池、内庭
E. 脾俞、肾俞

正确答案：D。曲池、内庭

解析：本题考查常见的病症的辩证、处方。题中患者两天前因食不洁水果，出现腹痛腹泻，可辩证为痢疾，并下痢赤白，里急后重，肛门灼热，心烦口渴，小便短赤，舌苔黄腻，脉滑数，可进一步辩证为痢疾中的湿热痢。中脘、气海合用可用于治疗寒湿痢（A错）。中脘、内关合用可用于治疗噤口痢（B错）。行间、足三里合用可用于调理肝脾，补益气血（C错）。曲池、内庭合用可用于治疗湿热痢（D对）。脾俞、肾俞合用可用于治疗休息痢（E错）。